下列有关小儿骨骼发育的叙述中正确的是
A. 前囟最晚闭合的年龄为10个月
B. 后囟一般闭合的年龄在出生后2周
C. 骨缝一般闭合的年龄为2个月
D. 6个月小儿出现第三个生理弯曲
E. 1～9岁儿童腕部骨化中心的数目约为小儿的年龄加1

正确答案：E。1～9岁儿童腕部骨化中心的数目约为小儿的年龄加1

解析：前囟出生时约1.0～2.0cm，1～2岁时闭合。后囟一般于生后6～8周时闭合。骨缝一般于生后3～4个月时闭合。6个月小儿能坐时出现胸椎后凸（第二个生理弯曲）。1～9岁儿童骨龄简易计算法：腕部骨化中心的数目约为小儿的年龄加1。掌握“骨骼发育”知识点。